胆固醇在体内代谢后，主要是
A. 转变成胆固醇酯
B. 转变成维生素D₃
C. 合成胆汁酸
D. 合成类固醇激素
E. 转变成脂肪

正确答案：C。合成胆汁酸

解析：本题考查胆固醇在体内的代谢。胆固醇在体内代谢后，主要是合成胆汁酸（C对）。胆固醇可以在肾上腺皮质、睾丸、卵巢内作为原料合成类固醇激素（D错）、在皮肤转化为维生素D₃（B错）。胆固醇酯（A错）是血浆中游离胆固醇在卵磷脂胆固醇脂酰转移酶（LCAT）的催化下，生成胆固醇酯和溶血卵磷酯。脂肪（E错）即甘油三酯，是机体重要的能源物质，是由脂肪酸和甘油合成的。